评定维生素D营养状况较好的鉴定指标是
A. 血清钙
B. 血清磷
C. 血清钙磷乘积
D. 血清碱性磷酸酶
E. 血浆25-（OH）-D₃

正确答案：E。血浆25-（OH）-D₃